不属于舌骨下肌群的肌是
A. 胸骨舌骨肌
B. 甲状舌骨肌
C. 下颌舌骨肌
D. 肩胛舌骨肌
E. 胸骨甲状肌

正确答案：C。下颌舌骨肌

解析：舌骨下肌群包括胸骨舌骨肌（A对）、甲状舌骨肌（B对）、肩胛舌骨肌（D对）和胸骨甲状肌（E对），下颌舌骨肌（C错，为本题正确答案）不属于舌骨下肌群。